落枕穴位于手背第二三掌骨间，指掌关节后约
A. 0.5寸
B. 1寸
C. 1.5寸
D. 2寸
E. 2.5寸

正确答案：A。0.5寸

解析：落枕穴，即外劳宫，位于手背第二三掌骨间，指掌关节后约0.5寸（A对）。